男，50岁。干咳2周。既往吸烟史20余年，20支/天。胸部X线片检查示右上肺近胸膜处可见直径1.5cm的类圆形结节。为协助诊断，应首先采取的检查是
A. 支气管镜
B. 血清肿瘤标志物
C. 胸部CT
D. 痰细胞学检查
E. 胸部MRI

正确答案：C。胸部CT

解析：中老年男性，干咳2周，既往吸烟史20余年，20支/天（易诱发肺癌），检查发现右上肺近胸膜处可见直径1.5cm的类圆形结节（提示可能为周围型肺癌），因此首选检查为肺穿刺活检（靠近胸膜）或胸部CT（C对），以协助诊断。支气管镜常用于中央型肺癌检查（A错）。血清肿瘤标志物（B错）、痰细胞学检查（D错）对于肺癌的定性诊断意义不如CT（P267）。胸部MRI并非肺癌常用的检查手段，对碘过敏不能进行增强CT扫描的病例可考虑MRI检查（P267）（E错）。